肾素依赖性高血压患者，治疗首选的药物是
A. 噻嗪类利尿药
B. 血管紧张素Ⅱ受体拮抗剂
C. 糖皮质激素
D. 氨基糖苷类抗生素
E. 细胞毒药物

正确答案：B。血管紧张素Ⅱ受体拮抗剂

解析：肾素依赖性高血压患者，应注重肾功能的保护，而血管紧张素Ⅱ受体拮抗剂这类药物可以抑制血管紧张素Ⅱ与受体的结合，从而阻断血管紧张素Ⅱ的缩血管作用，从而使血管扩张，血压下降，对肾素依赖性高血压有非常好的降压效果。故首选药物为血管紧张素Ⅱ受体拮抗剂（B对）。